患者，男，38岁，右侧脚趾发麻，皮肤干燥，毫毛脱落，趾甲增厚变形，呈干性坏疽，口干欲饮，便秘溲赤，舌红苔黄，脉弦细数，其证候是
A. 血脉瘀阻证
B. 湿热壅盛证
C. 营血两伤证
D. 热毒伤阴证
E. 邪毒内陷证

正确答案：D。热毒伤阴证

解析：患者表现为舌红苔黄，而非舌暗有瘀斑，不是血脉瘀阻证（A错）。皮肤干燥，不是湿热壅盛证（B错）。苔黄，脉弦细数，表示有实热邪气（C错）（D对）。无神昏、发热等表现，非邪毒内陷（E错）。